不属于血友病出血引起的症状的是
A. 局部疼痛、麻木
B. 肌肉萎缩
C. 局部缺血性坏死
D. 呼吸困难
E. 昏迷

正确答案：E。昏迷

解析：血友病临床表现为出血血肿压迫症状明显，随部位不同有不同表现，血肿压迫周围神经可致局部疼痛、麻木及肌肉萎缩；压迫血管可致相应供血部位缺血性坏死或淤血、水肿；口腔底部、咽后壁、喉部及颈部出血可致呼吸困难甚至窒息；压迫输尿管致排尿困难；腹膜后出血可引起麻痹性肠梗阻。掌握“血友病”知识点。